男，48岁。上腹不适纳差2年。胃镜检查提示慢性萎缩性胃炎，黏膜病理检查示重度肠上皮化生，为防止癌变，最适合的随访检査方法是
A. 腹部CT
B. 腹部B超
C. 上消化道造影
D. 胃镜
E. 血清肿瘤标志物

正确答案：D。胃镜

解析：中年男性患者，上腹不适，胃镜检查提示慢性萎缩性胃炎，病理示黏膜重度肠上皮化生。为防止癌变，最适合的随诊检查方法是胃镜（D对）。通过胃镜可以直接钳取病变的胃黏膜组织行病理组织学检查（胃癌诊断的金标准），能及早的发现癌变。腹部CT（A错）对评价胃癌病变范围、局部淋巴结和远处转移具有重要价值，但对早期胃黏膜病变的诊断价值不大。腹部B超（B错）常用于实质脏器，如肝、胆、胰等疾病的诊断，对空腔脏器的显示效果不佳。上消化道造影（C错）可以发现早期的胃黏膜改变，但不能取活检进行组织学检查，因此不能确诊胃癌。血清肿瘤标志物（E错）在胃癌患者中的特异性不高，不适合用于随访。